社区卫生服务的内容是
A. 预防
B. 医疗
C. 保健与康复
D. 健康教育与计划生育
E. 以上均是

正确答案：E。以上均是